某男，45岁。消渴病史2年，症见头晕耳鸣、腰膝酸软、骨蒸潮热、盗汗遗精。医师处以六味地黄丸。六味地黄丸全方配伍三补三泻，其中能泻肝火，退虚热的药是
A. 熟地黄
B. 泽泻
C. 牡丹皮
D. 山药
E. 茯苓

正确答案：C。牡丹皮

解析：本题考查的是六味地黄丸的方义简释。六味地黄丸全方配伍三补三泻，其中能泻肝火，退虚热的药是牡丹皮（C对）。六味地黄丸：【方义简释】方中熟地黄（A错）质润黏腻，甘补微温，药力颇强，善滋补肾阴、填精益髓，故重用为君药。酒萸肉酸涩收敛，甘微温而补，善补益肝肾、收敛固涩；山药（D错）甘补兼涩，性平不偏，既养阴益气、补脾肺肾，又固精缩尿。二药相合，既助君药滋养肾阴，又固精止汗，故为臣药。泽泻（B错）甘寒渗利清泄，善泄相火、渗利湿浊；茯苓（E错）甘淡渗利兼补，性平不偏，善健脾、渗利水湿；牡丹皮苦泄辛散，微寒能清，善清泻肝火、退虚热。三药相合，能清降相火、渗利湿浊、健脾，使君臣药填补真阴而不腻，清降虚火而不燥，固肾涩精而不滞，故为佐药。全方配伍，三补三泻，共奏滋阴补肾之功，故善治肾阴亏损所致的头晕耳鸣、腰膝酸软、骨蒸潮热、盗汗遗精、消渴。